女，18岁。发热一月，近一周来两面颊出现对称性红斑，手指关节红肿，化验：血红蛋白90g/L，白细胞3.0×10⁹/L，尿蛋白+++，抗ds-DNA抗体阳性，应首先考虑诊断
A. 缺铁性贫血
B. 慢性肾炎
C. 类风湿关节炎
D. 系统性红斑狼疮
E. 风湿热

正确答案：D。系统性红斑狼疮

解析：年轻女性患者（系统性红斑狼疮好发人群），出现发热一月、双面颊对称性红斑、手指关节红肿（系统性红斑狼疮常见表现）。实验室检查患者出现中度贫血（成年女性Hb60g/L～90g/L为中度贫血）、白细胞减少（系统性红斑狼疮血液系统改变），尿蛋白（+++）（系统性红斑狼疮累及肾），抗dsDNA抗体阳性（系统性红斑狼疮特异性抗体），考虑诊断为系统性红斑狼疮（D对）。缺铁性贫血 （A错）常有铁摄入不足或铁丢失过多的诱因，临床常见症状为乏力，易倦，面色苍白等（P542），但无双颊对称性红斑、蛋白尿及抗dsDNA抗体阳性。慢性肾炎（慢性肾小球肾炎）（B错）以中青年男性多见，蛋白尿、血尿、高血压与水肿是其主要表现（P478），但无双颊对称性红斑及抗dsDNA抗体阳性。类风湿关节炎（C错）多以缓慢隐匿的方式起病，以后逐渐出现明显的关节症状，常累及腕、掌指、近端指间关节，肾脏受累少见，无双颊对称性红斑，其免疫学异常为RA阳性而抗dsDNA抗体多阴性（P808）。风湿热（E错）多见于5～15岁的儿童和青少年，多有链球菌感染的前驱症状，临床表现以关节炎和心脏炎为主，但无双颊对称性红斑、蛋白尿及抗dsDNA抗体阳性。